肺形态的描述，哪项错误
A. 肺形态大致呈圆锥形
B. 肺尖高出锁骨内1/3上方2~3cm
C. 右肺狭长，分3叶
D. 外侧面圆凸、称肋面
E. 左肺前缘下部有心切迹

正确答案：C。右肺狭长，分3叶

解析：右肺宽而短，分3叶（C错，为本题正确答案）。肺形态大致呈圆锥形（A对）。肺尖高出锁骨内1/3上方2~3cm（B对）。肺外侧面圆凸、称肋面（D对）。左肺前缘下部有心切迹（E对）。